大卫生观包括的主要内容
A. 卫生事业结构简单，是种刚起步的社会性事业
B. 生物、心理、社会医学模式的确立给人类健康事业带来全方位的影响
C. 重点是社会环境的完美化
D. 基础医学、临床医学、预防医学三大学科的基本内容
E. 保障人类健康仅取决于医学发展

正确答案：B。生物、心理、社会医学模式的确立给人类健康事业带来全方位的影响